检查某药物中的重金属，称取供试品2.0g，依法检查，与标准铅溶液（每1ml相当10㎍的Pb）2ml用同法制成的对照液比较，不得更深。重金属的限量是
A. 0.0001
B. 5.0E-5
C. 2.0E-5
D. 1.0E-5
E. 5.0E-6

正确答案：D。1.0E-5